下列哪一项属于皮脂腺囊肿的最佳治疗方法
A. 切开引流
B. 囊内注射硬化剂
C. 冷冻治疗
D. 激光治疗
E. 局麻下手术切除

正确答案：E。局麻下手术切除

解析：皮脂腺囊肿治疗：在局麻下手术切除。沿颜面部皮纹方向做梭形切口，应切除包括与囊壁粘连的皮肤。掌握“皮脂腺、皮样或表皮样囊肿”知识点。